患者，女，56岁。阴部奇痒干涩7天，五心烦热，腰酸腿软，舌红少苔，脉细数。治疗应首选
A. 知柏地黄汤
B. 保阴煎
C. 两地汤
D. 六味地黄丸
E. 左归丸

正确答案：A。知柏地黄汤

解析：该患者阴部奇痒干涩7天，是因为肝肾阴虚，精血亏虚，血虚生风化燥，肌肤失养，瘙痒干涩；五心烦热，腰酸腿软，舌红少苔，脉细数均为肝肾阴虚之象且虚火明显，故治疗用知柏地黄汤滋阴补肾，清肝止痒（A对）。保阴煎功效清热凉血，固冲止血，多用于治疗月经过多血热证（B错）。两地汤滋阴清热，用于肾水不足，虚热内炽，月经先期，量少色红并伴有两颧潮红，手足心热等阴虚之象（C错）。六味地黄丸功效滋补肝肾，主要治疗肝肾阴虚证，症见腰膝酸软，头晕目眩，耳鸣耳聋，骨蒸潮热，口燥咽干，牙齿动摇等，此为治疗肝肾阴虚的基础方，若治疗虚火明显者需配伍知母玄参黄柏，化方知柏地黄丸（D错）。左归丸功效滋阴补肾，填精益髓，可治疗真阴不足，症见：头晕目眩，腰酸腿软，遗精滑泄，自汗盗汗，口燥舌干，舌红少苔，脉细（E错）。